下列有关胸腺（thymus）中T细胞经历阳性选择和阴性选择过程，说法错误的是
A. 阳性选择的过程中，T细胞通过TCR和周围细胞表面的HLA分子识别结合
B. 阳性选择的过程中，结合力低的T细胞发生凋亡而被清除
C. 阳性选择的过程中，结合力高的T细胞获得继续分化成熟的机会
D. 阴性选择的过程中，针对自身抗原的T淋巴细胞可被清除
E. 阳性选择不充分成为引发自身免疫性疾病的隐患

正确答案：E。阳性选择不充分成为引发自身免疫性疾病的隐患

解析：骨髓是各类免疫细胞发生的场所，也是B细胞分化、发育和成熟的场所。骨髓功能缺陷会导致体液免缺陷或联合免疫缺陷。胸腺（thymus）是T细胞经历阳性选择和阴性选择的场所。在阳性选择的过程中，T细胞通过TCR和周围细胞表面的HLA分子识别结合，结合力低的T细胞发生凋亡而被清除，结合力高的T细胞获得继续分化成熟的机会。在阴性选择的过程中，针对自身抗原的T淋巴细胞可被清除。若阴性选择不充分，一些针对自身抗原的自身反应性T细胞（T-cell）进入外周循环，成为引发自身免疫性疾病的隐患。掌握“中枢和外周免疫器官”知识点。